心指数等于
A. 心率×每搏输出量/体表面积
B. 每搏输出量×体表面积
C. 每搏输出量/体表面积
D. 心输出量×体表面积
E. 心率×每搏输出量×体表面积

正确答案：A。心率×每搏输出量/体表面积

解析：心指数是比较身材不同个体的心功能的评价指标。心指数=心输出量/体表面积，而心输出量=心率×搏出量，所以心指数=心率×每搏输出量/体表面积（A对）。